破伤风病人的治疗原则是
A. 预防和抢救休克
B. 早期气管切开术
C. 清除毒素来源、中和毒素、控制和解痉治疗
D. 高压氧治疗
E. 应用破伤风类毒素

正确答案：C。清除毒素来源、中和毒素、控制和解痉治疗

解析：破伤风是一种极为严重的疾病，死亡率极高，为此应该采取积极的综合治疗措施，包括清除毒素来源，中和游离毒素，控制和解除痉挛，保持呼吸道畅通和防止并发症等原则。其他为具体操作措施。掌握“特殊性感染”知识点。